婴儿吮吸拇指或用过硬的橡皮奶头引起双侧翼钩处黏膜表面溃疡，称为
A. 创伤性溃疡
B. 压疮性溃疡
C. Bednar溃疡
D. Riga-Fede溃疡
E. 复发性阿弗他溃疡

正确答案：C。Bednar溃疡

解析：本题考查贝氏溃疡。婴儿吮吸拇指或用过硬的橡皮奶头引起双侧翼钩处黏膜表面溃疡，称为Bednar溃疡（C对）。1.不同原因引起的创伤性溃疡有不同的病名，临床表现也有所不同。（1）贝氏溃疡（Bednar ulcer）：由婴儿吮吸拇指或过硬的橡皮奶头引起。固定发生于硬腭、双侧翼钩处黏膜表面，双侧对称性分布。溃疡表浅，婴儿哭闹不安，拒食。（2）压疮性溃疡（B错）：由持久的非自伤性机械性刺激造成。多见于老年人。残根残冠或不良修复体长期损伤黏膜，溃疡深及黏膜下层，边缘轻度隆起，色泽灰白，疼痛不明显。（3）李-弗溃疡（Riga-Fede ulcer）（D错）：专指发生于婴幼儿舌腹的溃疡。因过短的舌系带和过锐的新萌乳中切牙长期摩擦引起，舌系带处充血肿胀、溃疡。久不治疗则转变为肉芽肿性溃疡，扪诊有坚韧感，影响舌活动。此外还有自伤性溃疡、化学灼伤性溃疡和热灼伤性溃疡等。2.复发性阿弗他溃疡（E错）：一般表现为反复发作的圆形或椭圆形溃疡，具有“黄、红、凹、痛”的临床特征，即溃疡表面覆盖黄色假膜、周围有红晕带、中央凹陷、疼痛明显。溃疡的发作周期长短不一，可分为发作期（前驱期-溃疡期）、愈合期、间歇期，且具有不治自愈的自限性。